可在微生物膜上形成孔道使其发生渗透裂解的物质是
A. 膜攻击复合物
B. I因子
C. CD59
D. S蛋白
E. C8组合蛋白

正确答案：A。膜攻击复合物

解析：膜攻击复合物（MAC）可在微生物膜上形成孔道使其发生渗透性裂解，也可造成宿主细胞的破坏。掌握“补体功能及其与疾病的关系”知识点。